女，58岁。反复心前区疼痛，常在休息或清晨时发作，持续时间一般为20～30分钟，含服硝酸甘油10分钟可级解。疼痛发作时，心电图胸前导联ST段拾高，运动负荷试验阴性，其诊断为
A. 初发型心绞痛
B. 卧位型心绞痛
C. 稳定型心绞痛
D. 变异型心绞痛
E. 恶化型心绞痛

正确答案：D。变异型心绞痛